治疗夜盲症，应选用的药物是
A. 砂仁
B. 苍术
C. 白豆蔻
D. 藿香
E. 厚朴

正确答案：B。苍术

解析：苍术的功效为燥湿健脾，祛风散寒，明目。治疗湿阻中焦，脘腹胀满，泄泻，水肿；风湿痹痛，脚气痿躄；风寒感冒；夜盲，眼目昏涩（B对）。砂仁的功效为化湿开胃，温中止泻，理气安胎。治疗湿浊中阻，脾胃气滞，脘痞不饥；脾胃虚寒，呕吐泄泻；妊娠恶阻，胎动不安（A错）。白豆蔻的功效为化湿行气，温中止呕，开胃消食。治疗湿浊中阻，脾胃气滞，不思饮食，胸腹胀痛，食积不消；湿温初起，胸闷不饥；寒湿呕逆（C错）。藿香的功效为芳香化湿，和中止呕，发表解暑。治疗湿浊中阻，脘腹痞闷；呕吐；暑湿表证，湿温初起，发热倦怠，胸闷不舒；寒湿闭暑，腹痛吐泻（D错）。厚朴的功效为燥湿，行气，消积，消痰平喘。治疗湿滞伤中，脘痞吐泻；食积气滞，腹胀便秘；痰饮喘咳（E错）。